以下符合开具处方的条件的是
A. 医师必须在注册的医疗机构签名留样或者专用签章备案，方可开具处方
B. 经注册的执业助理医师在医疗机构开具的处方
C. 医师取得麻醉药品处方权，为自己开具该类药品
D. 试用期人员开具的处方
E. 医师取得第一类精神药品处方权，为自己开具该类药品

正确答案：A。医师必须在注册的医疗机构签名留样或者专用签章备案，方可开具处方

解析：开具处方的条件：①医师应当在注册的医疗机构签名留样或者专用签章备案后，方可开具处方。②经注册的执业助理医师在医疗机构开具的处方，应当经所在执业地点执业医师签名或加盖专用签章后方有效。③医师取得麻醉药品和第一类精神药品处方权后，方可在本机构开具麻醉药品和第一类精神药品处方，但不得为自己开具该类药品处方。药师取得麻醉药品和第一类精神药品调剂资格后，方可在本机构调剂麻醉药品和第一类精神药品。④试用期人员开具处方，应当经所在医疗机构有处方权的执业医师审核、并签名或加盖专用签章后方有效。掌握“处方管理概述及一般规定、处方权”知识点。